具配位键结构的生物碱是
A. 苦参碱
B. 羟基苦参碱
C. 氧化苦参碱
D. 去氢苦参碱
E. 安那吉碱

正确答案：C。氧化苦参碱

解析：本题考查的是苦参生物碱的溶解性。具配位键结构的生物碱是氧化苦参碱（C对）。苦参所含主要生物碱是苦参碱和氧化苦参碱，《中国药典》以其为指标成分进行鉴别和含量测定，含量测定要求苦参碱和氧化苦参碱总量不得少于1.2%。此外苦参碱还含有羟基苦参碱、N-甲基金雀花碱、安那吉碱（E错）、巴普叶碱和去氢苦参碱（D错）（苦参烯碱）等。这些生物碱都属于双稠哌啶类，具喹喏里西啶的基本结构，除N-甲基金雀花碱外，均由两个哌啶环共用一个氮原子稠合而成。分子中均有两个氮原子，一个是叔胺氮，一个是酰胺氮。苦参总生物碱具有抗肿瘤、抗病原微生物、抗心律失常、解热、抗炎、抗变态反应和调节免疫等作用。苦参生物碱的溶解性：苦参碱（A错）的溶解性比较特殊，既可溶于水，又能溶于三氯甲烷、乙醚、苯、二硫化碳等亲脂性溶剂。氧化苦参碱是苦参碱的N-氧化物，具半极性配位键，其亲水性比苦参碱更强，易溶于水，可溶于三氯甲烷，但难溶于乙醚。可利用两者溶解性的差异将其分离。苦参碱、氧化苦参碱和羟基苦参碱（B错）具内酰胺结构，可在碱性溶液中加热水解皂化成羧酸衍生物，酸化后又环合析出。